女，35岁。间断粘液脓血便2年。伴里急后重，大便每日3次，反复应用多种抗生素治疗，症状无明显缓解，最有可能诊断的是
A. 慢性细菌性痢疾
B. 肠伤寒
C. 阿米巴痢疾
D. 溃疡性结肠炎
E. 肠易激综合征

正确答案：D。溃疡性结肠炎

解析：患者腹泻、黏液脓血便、里急后重，且多种抗生素治疗无效，最有可能诊断的是溃疡性结肠炎（D对），治疗是抗炎治疗。慢性细菌性痢疾（A错）抗生素可治愈。肠伤寒（B错）抗生素治疗有效（九版传染病学P155）。阿米巴痢疾（C错）抗阿米巴治疗有效。肠易激综合征（E错）粪便有黏液但无脓血。